反映受检人群龋病严重程度的指数是
A. 龋均
B. 无龋率
C. 患龋率
D. 充填比率
E. 龋病发病率

正确答案：A。龋均

解析：龋均和龋面均反映受检查人群龋病的严重程度，但两者反映人群龋病严重程度的敏感性不同。掌握“龋病流行病学”知识点。